女婴，8个月。水样便3天，10余次/日，呕吐3～4次/日，尿量减少。查体体重8Kg，眼窝凹陷，皮肤弹性差，四肢尚暖，血钠125mmol/L。第一天补充液体的种类是
A. 2/3张含钠液
B. 1/4张含钠液
C. 1/2张含钠液
D. 1/3张含钠液
E. 等张含钠液

正确答案：A。2/3张含钠液

解析：第一天补充液体的种类是根据脱水的性质，低渗性水为4：3：2液、等渗性脱水为2：3：1液、高渗性脱水为2：6：1液。体检得血钠125mmol/L在低于130mmol/L的范围内，可诊断为低渗性脱水。因此应补充4：3：2液，换算成张力为（4+2）/（4+3+2）=2/3张（A对）。